利福平的抗菌作用机制是
A. 抑制细菌分枝菌酸的合成
B. 抑制细菌叶酸的合成
C. 抑制细菌DNA螺旋酶
D. 抑制细菌依赖于DNA的RNA多聚酶
E. 抑制细菌蛋白质的合成

正确答案：D。抑制细菌依赖于DNA的RNA多聚酶

解析：本题考查利福平的作用机制。利福平的抗菌作用机制是抑制细菌依赖于DNA的RNA多聚酶（D对）。利福平在低浓度时抑菌，高浓度时杀菌，其作用机制是与依赖于DNA的RNA多聚酶的β亚单位牢固结合，抑制细菌RNA的合成。